医师注册后，以下哪种情形不需要吊销注册的
A. 死亡的
B. 受到警告行政处罚的
C. 被宣告失踪的
D. 受吊销医师执业证书行政处罚的
E. 中止医师执业活动满2年的

正确答案：B。受到警告行政处罚的

解析：医师注册后有下列情形之一的，其所在的医疗、预防、保健机构应当在30日内报告准予注册的卫生行政部门，卫生行政部门应当注销注册，收回医师执业证书：①死亡的（A对）或者被宣告失踪的（C对）；②受刑事处罚的；③受吊销医师执业证书行政处罚的（B错，为本题正确答案）（D对）；④因考核不合格，暂停执业活动期满，经培训后再次考核仍不合格的；⑤中止医师执业活动满2年的（E对）；⑥身体健康状况不适宜继续执业的；⑦有出借、出租、抵押、转让、涂改《医师执业证书》行为的；⑧有国务院卫生行政部门规定不宜从事医疗、预防、保健业务的其他情形的。